胫骨内侧髁下方至内踝尖的骨度分寸是
A. 12寸
B. 13寸
C. 6寸
D. 8寸
E. 9寸

正确答案：B。13寸

解析：根据骨度分寸量表，胫骨内侧髁下方至内踝尖的骨度分寸是13寸（B对）。